糖皮质激素抗休克作用与哪一因素无关
A. 扩张痉挛收缩血管，加强心肌收缩力
B. 稳定溶酶体膜，减少心肌抑制因子的释放
C. 提高机体对细菌内毒素的耐受力
D. 降低血管对某些缩血管物质的敏感性
E. 中和外毒素

正确答案：E。中和外毒素